穿心莲粉末显微特征中可见
A. 草酸钙针晶
B. 草酸钙砂晶
C. 橙皮苷结晶
D. 碳酸钙钟乳体
E. 草酸钙簇晶

正确答案：D。碳酸钙钟乳体

解析：本题考查的是穿心莲的显微鉴别。穿心莲粉末显微特征中可见碳酸钙钟乳体（D对）。穿心莲【显微鉴别】叶粉末：鲜绿色。上下表皮均有增大的晶细胞，内含大型螺状钟乳体，直径约至32㎛，长约至180㎛，较大端有脐样点痕，层纹波状。下表皮气孔直轴式，副卫细胞大小悬殊，少数为不定式。腺鳞头部扁球形，4、6或8细胞，直径27～33㎛，柄仅3㎛。广藿香【显微鉴别】叶片粉末：淡棕色。非腺毛1～6细胞，平直或先端弯曲，长约至590㎛，壁具刺状突起，有的胞腔含黄棕色物质。叶表皮细胞不规则形，气孔直轴式，副卫细胞清晰可见。腺鳞头部扁球形，由8个细胞组成，直径37～70㎛，柄单细胞，极短。小腺毛头部2细胞，柄1～3细胞，甚短。草酸钙针晶（A错）细小，散在于叶肉细胞中，长约至27㎛。牛膝【显微鉴别】粉末：土黄色。木纤维较长，壁微木化，胞腔大，具斜形单纹孔。导管网纹、单纹孔或具缘纹孔。薄壁细胞含草酸钙砂晶（B错）。薄荷【显微鉴别】叶横切面：上表皮细胞呈方形，下表皮细胞细小扁平，均被角质层，有气孔；上下表皮凹陷处有腺鳞。栅栏组织通常为1列细胞。海绵组织为4～5列细胞。主脉上下表皮内方有厚角组织及薄壁组织。表皮细胞、叶肉细胞、薄壁细胞及导管中有时含有橙皮苷结晶（C错）。槲寄生【显微鉴别】茎粉末：淡黄色。表皮细胞类方形，可见气孔。纤维成束，直径10～34㎛，壁较厚，略成波状，微木化。异形细胞形状不规则，壁较厚，微木化，胞腔大。草酸钙簇晶（E错）直径17～45㎛。